服用左旋多巴不宜同食
A. 葡萄柚汁
B. 咖啡
C. 食醋
D. 高蛋白
E. 高脂肪

正确答案：D。高蛋白

解析：本题考查饮食对药物疗效的影响。服用左旋多巴不宜同食高蛋白（D对）。高蛋白食物在肠内产生大量氨基酸，阻碍左旋多巴的吸收。葡萄柚汁（A错）主要影响CYP3A4代谢，同时抑制CYP3A4的活性，不能与通过CYP3A4代谢的药物同时服用。咖啡（B错）刺激胃液和胃酸分泌，有胃溃疡或胃酸过多的人不宜饮用。食醋（C错）不宜与磺胺药同服，后者在酸性条件下溶解度降低，可在尿道中形成磺胺结晶，对尿路产生刺激，出现尿闭和血尿。高脂肪（E错）食物可促进胆汁分泌，延缓胃排空速度，使灰黄霉素的吸收增加。